牙周脓肿区别于牙龈脓肿的特点是
A. 瘘管形成
B. 局限于龈乳头和龈缘
C. 肿胀部位有深牙周袋
D. 牙龈组织局限性的“膨隆”
E. 有异物刺入牙龈的刺激因素

正确答案：C。肿胀部位有深牙周袋

解析：本题考查牙周脓肿与牙龈脓肿的鉴别。牙周脓肿区别于牙龈脓肿的特点是肿胀部位有深牙周袋（C对）。牙龈脓肿无附着丧失、牙周袋形成；牙周脓肿有较深的牙周袋。连接两个内脏器官或从内脏器官通向体表的通道样缺损称为瘘管（A错）。牙龈脓肿为局限于龈乳头和龈缘的炎症；牙周脓肿为局限于牙周袋壁、靠近龈缘的化脓性炎症（BD错）。牙龈脓肿可因异物刺入牙龈引起；牙周脓肿是牙周炎晚期常见伴发症状（E错）。